对长而尖的畸形中央尖的处理方法是
A. 一次磨去中央尖后银汞充填
B. 分次磨短中央尖，每次磨后涂氟
C. 一次磨去中央尖后封牙髓失活剂
D. 麻醉下磨去中央尖后做干髓治疗
E. 麻醉下磨去中央尖后做根管治疗

正确答案：B。分次磨短中央尖，每次磨后涂氟

解析：本题考查畸形中央尖的治疗。对长而尖的畸形中央尖的处理方法是分次磨短中央尖，每次磨后涂氟（B对）。畸形中央尖的病例中半数的中央尖内有髓角伸入，对于尖而长的中央尖容易折断或被磨损而露髓，为防止中央尖折断和并发症发生，可采用分次磨除法或充填法。分次磨除法每次磨除厚度不超过0.5mm，磨去后涂以75%氟化钠甘油，间隔4～6周一次，直到完全磨去，逐渐磨除有利于刺激修复性牙本质形成，避免牙髓暴露。一次磨去中央尖通常会引起牙髓的暴露，需先盖髓，不能直接进行银汞充填（A错）。刚萌出的牙齿，牙根尚未发育完全，治疗时应保存活髓，使牙根继续发育，对于尖而长的中央尖不宜一次磨除中央尖封失活剂，或进行干髓或根管治疗（CDE错）。